急性心肌梗死的心电图表现是
A. 病理性Q波或QS波，ST段抬高，T波倒置
B. 心电图除aVR导联外，其他导联均呈弓背向下型抬高、T波倒置，无异常Q波出现
C. V1、V2、V3导联呈QS型，ST段抬高，T波双向
D. 病理性Q波已发生半年，ST段仍持续抬高
E. Ⅱ、Ⅲ、aVF、V5～6导联中Q波深而不宽

正确答案：A。病理性Q波或QS波，ST段抬高，T波倒置

解析：急性心肌梗死的心电图表现是病理性Q波或QS波，ST段抬高，T波倒置（A对）。心电图除aVR导联外，其他导联均呈弓背向下型抬高、T波倒置，无异常Q波出现提示心绞痛（B错）。V1、V2、V3导联呈QS型，ST段抬高，T波双向为急性前间壁心肌梗死心电图表现（C错）。病理性Q波已发生半年，ST段仍持续抬高提示心肌梗死损伤区的表现（D错）。Ⅱ、Ⅲ、aVF、V5～6导联中Q波深而不宽为急性下侧壁心肌梗死心电图表现（E错）。